对津液代谢起主宰作用的脏是
A. 心
B. 肺
C. 脾
D. 肝
E. 肾

正确答案：E。肾

解析：津液的生成、输布、和排泄过程即津液代谢，与多个脏腑的生理功能有关，是多脏腑相互协调、密切配合而完成的，但以肺脾肾三脏的功能最为重要。肺为水之上源，主通调水道。脾主运化水液。肝主疏泄，调畅气机，调节水液运行。心阳与津液的代谢也有一定作用。肾为水脏，主津液，主宰和调节全身水液的代谢。肾中精气的气化功能，对体能津液的输布和排泄及维持体内津液代谢的平衡起着决定的作用。肾的蒸腾气化，升清降浊促进水液代谢，且司膀胱开合，并能促进肺、脾、肝、三焦脏腑在水液代谢中的作用（E对）（ABCD错）。